《处方药与非处方药分类管理办法（试行）》规定，乙类非处方药的生产企业
A. 必须具有《药品生产许可证》
B. 生产品种必须取得药品批准文号
C. 必须具有法定的注册商标
D. 生产品种的包装必须印有国家规定的非处方药专有标识
E. 必须具有计量认证的考核合格证书

正确答案：A、B、D。必须具有《药品生产许可证》；生产品种必须取得药品批准文号；生产品种的包装必须印有国家规定的非处方药专有标识

解析：本题考查《处方药与非处方药分类管理办法（试行）》。《处方药与非处方药分类管理办法（试行）》规定，乙类非处方药的生产企业必须具有《药品生产许可证》（A对）、生产品种必须取得药品批准文号（B对）、生产品种的包装必须印有国家规定的非处方药专有标识（D对）。《处方药与非处方药分类管理办法（试行）》第五条：处方药、非处方药生产企业必须具有《药品生产企业许可证》，其生产品种必须取得药品批准文号。第七条：非处方药的包装必须印有国家指定的非处方药专有标识，必须符合质量要求，方便储存、运输和使用。每个销售基本单元包装必须附有标签和说明书